为避免先天性双侧唇腭裂患儿前颌突过度生长，出生后应尽早行
A. 咽成形术
B. 正畸治疗
C. 唇裂修补术
D. 牙槽突裂植骨术
E. 腭裂整复术

正确答案：B。正畸治疗

解析：本题考查唇腭裂的序列治疗。为避免先天性双侧唇腭裂患儿前颌突过度生长，出生后应尽早行正畸治疗（B对）。唇腭裂序列治疗顺序为新生儿正畸治疗、唇裂修复（C错）、腭裂修复（AE错）、术后语音效果观察和语音治疗、乳牙期及替牙期正畸治疗、牙槽突植骨术（D错）、外科正畸治疗、矫形修复治疗、唇腭裂的二期修复、耳科治疗和心理治疗。为避免先天性双侧唇腭裂患儿前颌突过度生长，出生后应尽早行正畸治疗。出生后3个月内佩戴腭托矫正器，并可以保持两侧颌骨间隙。